下列有关骨化纤维瘤的特点中不正确的是
A. 女性较为多见
B. 主要发生于10～39岁
C. 不同组织学亚型的发病年龄有差异
D. 边界不清
E. 随着肿瘤增大可引起牙移位

正确答案：D。边界不清

解析：骨化纤维瘤主要发生于10～39岁，女性多见。不同组织学亚型的发病年龄有差异，JTOF（青少年小梁状骨化纤维瘤）发病年龄较小（8.5～12岁），JPOF（青少年沙瘤样骨化纤维瘤）患者平均年龄约20岁，而经典的骨化纤维瘤为35岁。主要见于下颌后部，JTOF（青少年小梁状骨化纤维瘤）好发于上颌，而JPOF（青少年沙瘤样骨化纤维瘤）主要发生于鼻窦的骨壁。早期无症状，随着肿瘤增大，可由于颌骨膨隆引起牙移位、关系紊乱和颌面部变形。X线表现为境界清楚的、单房性密度减低区，由于伴有硬组织形成，在病变的中央区域常见不透光区。肿瘤界限清楚，有包膜，剖面呈黄白色、呈实性。掌握“骨化纤维瘤”知识点。